关于下颌下腺炎的叙述，哪项是错误的
A. 多为涎石造成唾液排出受阻继发感染所致
B. 反复发作者下颌下腺可呈硬结性肿块
C. 双手触诊应从导管前部向后进行
D. 少数涎石X线片可能不显影
E. 腺内涎石需作下颌下腺摘除术

正确答案：C。双手触诊应从导管前部向后进行

解析：下颌下腺炎的时候常常伴有涎石病，因此在双合诊的时候一般是从后向前，以免将涎石推入导管深部或腺体。掌握“涎石病及下颌下腺炎”知识点。